男，26岁。发热乏力伴皮肤出血点2周。查体：贫血貌，牙龈肿胀，肝脾轻度肿大，化验：Hb75g/L，WBC28×10⁹/L，Plt57×10⁹/L，骨髓增生极度活跃，原始细胞84%，过氧化物酶染色弱阳性，非特异性酯酶染色阳性，阳性反应可被氟化钠抑制，该患者最可能的诊断是
A. 急性淋巴细胞白血病
B. 急性巨核细胞白血病
C. 急性单核细胞白血病
D. 急性粒细胞白血病
E. 红白血病

正确答案：C。急性单核细胞白血病

解析：患者青年男性，发热、乏力伴皮肤出血点2周（贫血、发热、出血是急性白血病正常骨髓造血功能受抑制的表现），查体：贫血貌，牙龈肿胀，肝脾轻度肿大（白血病细胞浸润可使肝脾肿大，牙龈增生、肿胀，后者多见于M₄、M₅），化验：Hb75g/L（成年男性Hb正常120～160g/L），提示贫血，WBC28×10⁹/L（正常4～10×10⁹/L）增多，Plt57×10⁹/L（正常100～300×10⁹/L）减少，骨髓增生极度活跃，原始细胞84%（原始细胞≥30%（FAB分型）或≥20%（WHO分型）即可诊断为急性白血病），过氧化物酶染色弱阳性（见于急性单核细胞白血病、分化差的急性粒细胞白血病），非特异性酯酶染色阳性，阳性反应可被氟化钠抑制（仅见于急性单核细胞白血病），故患者最可能的诊断为急性单核细胞白血病（M₅）（C对）。急性淋巴细胞白血病（P569）（A错）常见淋巴结肿大，过氧化物酶染色、非特异性酯酶染色均阴性；急性巨核细胞白血病（P569）（B错）血小板抗原阳性，血小板过氧化物酶阳性；急性粒细胞白血病（D错）过氧化物酶强阳性，非特异性酯酶阳性，但氟化钠不能抑制；红白血病（E错）骨髓中幼红细胞大于50%，糖原染色强阳性。